女，47岁。双眼睑下垂，复视伴吞咽困难2个月，症状在下午和劳累后加重，为明确诊断需完善的检查不包括
A. Ach受体抗体滴度
B. 血清铜
C. 新斯的明试验
D. 纵隔CT
E. 肌疲劳试验

正确答案：B。血清铜

解析：中年女性患者，复视伴吞咽困难2个月，症状表现为“晨轻暮重”波动现象，应诊断为重症肌无力。重症肌无力是自身抗体介导的突触后膜AchR损害，检查包括：乙酰胆碱（ACh）受体抗体滴度的检测（A对）、新斯的明试验（C对）（重症肌无力患者肌注新斯的明1mg，20分钟后肌无力症状即可明显减轻）、纵隔CT（D对）（重症肌无力患者纵膈CT可发现胸腺增生和肥大）、重复电刺激、单纤维肌电图、肌疲劳试验（E对）（重症肌无力患者持续上视出现上睑下垂或两臂持续平举后出现上臂下垂，休息后恢复）。血清铜（B错，为本题正确答案）检测常见于肝豆状核变性，但对重症肌无力的诊断无帮助。